手三阳经的循行是
A. 从胸走手
B. 从足走腹
C. 从头走足
D. 从手走头
E. 从腹走胸

正确答案：D。从手走头

解析：十二经脉循行走向总的规律是：手三阳从手走头（D对）。手三阴从胸走手（A错），足三阳从头走足（C错），足三阴从足走腹胸（B错）。